伤寒最严重的并发症
A. 肺炎
B. 肠穿孔
C. 血栓性静脉炎
D. 中毒性心肌炎
E. 肠出血

正确答案：B。肠穿孔

解析：伤寒的并发症有肠出血、肠穿孔、中毒性肝炎、中毒性心肌炎（D错）和其他，如肺炎（A错）、血栓性静脉炎（C错）。其中肠出血（E错）最常见（P152），肠穿孔（B对）最严重（P152）。